表层皮片的厚度是
A. 0.1mm
B. 0.2～0.25mm
C. 0.8～1.0mm
D. 0.35～0.8mm
E. 1.2～1.5mm

正确答案：B。0.2～0.25mm

解析：本题考查表层皮片的厚度。表层皮片包括表皮层和很薄一层真皮最上层的乳头层，厚度约为0.2～0.25mm（B对A错），移植后生活力强，抗感染力亦强，能生长在有轻微感染经过适当处理后的肉芽创面上；也能生长在渗血的骨、肌、脂肪、肌腱等组织创面上；过薄，没有临床价值。中厚皮片包括表皮及一部分真皮层，厚度约为0.35～0.80mm（D错）。全厚皮片包括表皮及真皮的全层（CE错），这种皮片生长成活后，柔软而富有弹性，活动度大，能耐摩擦及负重，收缩小，色泽变化亦小，特别适颌面部植皮。